可以直接获得暴露组与非暴露组的发病率或死亡率，并可以直接计算相对危险度的研究为
A. 描述性研究
B. 病例对照研究
C. 队列研究
D. 流行病学实验研究
E. 分析性研究

正确答案：C。队列研究